专有标识为红色方框，底色内标注白色字样的是
A. 外用药品
B. 麻醉药品
C. 第二类精神药品
D. 医疗毒性药品

正确答案：A。外用药品

解析：本题考查药品专有标识管理。专有标识为红色方框，底色内标注白色字样的是外用药品（A对）。外用药品标识为红色方框底色内标注白色“外”字。国务院药品监督管理部门规定的麻醉药品（B错）专用标志样式：（颜色：天蓝色与白色相间）；精神药品（C错）的专用标志样式：（颜色：绿色与白色相间）。国务院药品监督管理部门规定的医疗用毒性药品（D错）的标志样式：（颜色：黑白相间，黑底白字）。